胸痹心痛患者，脉象多见
A. 滑
B. 促
C. 弦
D. 涩
E. 数

正确答案：C。弦

解析：胸痹心痛患者多因阳气不宣，血行无力，心脉阻滞不通所致；而弦脉可因经络不通而痛，脉气皆因此而紧张所致，故胸痹心痛患者，脉象多见弦脉（C对）。滑脉多见于痰湿、食积和实热等病证，亦是青壮年的常脉，妇女的孕脉（A错）。促脉多见于阳盛实热、气血痰食停滞，亦见于脏气衰败（B错）。涩脉多见于气滞、血瘀和精伤、血少（D错）。数脉多见于热证，亦见于里虚证（E错）。